承担最大咀嚼压力区的是
A. 主承托区
B. 副承托区
C. 缓冲区
D. 边缘封闭区
E. 后堤区

正确答案：A。主承托区

解析：主承托区：包括上下颌牙槽嵴顶的区域，以及除上颌硬区之外的硬腭水平部分。该区域表面通常为附着黏膜，有高度角化的复层鳞状上皮，黏膜下层致密，有一定的弹性，移动度小，能够抵抗义齿基托的压力，是承担义齿咀嚼压力的主要区域。掌握“无牙颌的解剖标志及功能分区”知识点。